以最小代价从而获得最大收获的是
A. 最优化原则
B. 患者至上原则
C. 知情同意原则
D. 保密守信原则
E. 酌情隐瞒原则

正确答案：A。最优化原则

解析：本题考查临床诊疗和临床诊断的伦理。最优化原则（A对）是指在选择诊疗方案时以最小的代价获得最大效果的决策。具体地说，医务人员在选择诊疗方案时，在当时的医学科学发展水平和客观条件下，采取的诊疗措施使患者的痛苦最小、耗费最少、效果最好、安全度最高。